当筛查人群中包含惰性病例时，可能会产生的偏倚是
A. 过度诊断偏倚
B. 病程偏倚
C. 志愿者偏倚
D. 领先时间偏倚
E. 信息偏倚

正确答案：A。过度诊断偏倚

解析：本题考查过度诊断偏倚的概念。过度诊断偏倚（A对BCDE错）是指因为筛检，惰性病例被发现、确诊患病、并被计入病人总体之中，导致经筛检发现的病人有较多的生存者或较长的平均生存期，从而高估了筛查效果。